L型细菌缺失哪一种结构
A. 细胞质
B. 细胞膜
C. 细胞核质
D. 细胞壁
E. 核糖体

正确答案：D。细胞壁